大便干结，数日一行，舌红少津，舌苔黄燥，脉细涩，其临床意义是
A. 胃肠气滞证
B. 胃阴亏虚证
C. 肠热腑实证
D. 肠燥津亏证
E. 胃热炽盛证

正确答案：D。肠燥津亏证

解析：阴津不足，肠道失濡，传导失职，则大便干结，数日一行；阴津亏损，濡润失职，则口干少津；舌红少津，舌苔黄燥，脉细涩，均为阴津亏损之象；故辨证为肠燥津亏证（D对）。胃肠气滞证的证候表现是胃脘、腹部胀满疼痛，走窜不定，痛而欲吐或欲泻，泻而不爽，嗳气，肠鸣，矢气，得嗳气、矢气后痛胀可缓解，或无肠鸣、矢气则胀痛加剧，或大便秘结，苔厚，脉弦（A错）。胃阴亏虚证的证候表现是胃脘隐隐灼痛，嘈杂不舒，饥不欲食，干呕，呃逆，口燥咽干，大便干结，小便短少，舌红少苔，脉细数（B错）。肠热腑实证的证候表现是腹部硬满疼痛、拒按，大便秘结，或热结旁流，气味恶臭，壮热，或日哺潮热，汗出口渴，甚则神昏澹语、狂乱，小便短黄，舌质红，苔黄厚而燥，或焦黑起刺，脉沉数有力，或沉迟有力（C错）。胃热炽盛证的证候表现是胃脘灼痛、拒按，消谷善饥，口气臭秽，齿龈红肿疼痛，甚则化脓、溃烂，或见齿衄，渴喜冷饮，大便秘结，小便短黄，舌红苔黄，脉滑数（E错）。